支气管哮喘患者发作时禁用的药物是
A. 吗啡
B. 氨茶碱
C. 泼尼松
D. 肾上腺素
E. 沙丁胺醇

正确答案：A。吗啡

解析：吗啡可抑制呼吸中枢，降低呼吸中枢对二氧化碳的敏感性，故不可用于支气管哮喘患者发作（A错，为本题正确答案）。泼尼松（C对）是糖皮质激素的一种，是目前控制哮喘最有效的药物。氨茶碱（B对）为磷酸二酯酶抑制剂：增加细胞内cAMP水平，松弛支气管平滑肌，减轻呼吸困难。肾上腺素（D对）、沙丁胺醇（E对）均可激动β₂受体，扩张支气管平滑肌，缓解哮喘症状。